髂内动脉
A. 起于髂外动脉
B. 起于腹主动脉
C. 发出直肠上动脉
D. 发出直肠下动脉
E. 发出肾动脉

正确答案：D。发出直肠下动脉

解析：髂内动脉起于髂总动脉（AB错）。髂内动脉发出直肠下动脉（D对CE错）等动脉。